慢性支气管炎急性发作伴细菌感染时，最主要的临床表现是
A. 咳嗽加重
B. 咳白色泡沫痰与黏液痰
C. 咳脓性痰且痰量增加
D. 肺部有哮鸣音
E. 肺底部有细湿啰音

正确答案：C。咳脓性痰且痰量增加

解析：慢性支气管炎的患者因支气管黏膜受炎症的刺激及分泌的黏液增多而出现咳嗽、咳痰的症状。痰液一般为白色黏液泡沫状，在急性发作期，咳嗽加剧，并出现黏液性脓性或脓性痰（第八版病理学P170），所以在急性发作伴细菌感染时，最主要的临床表现是咳脓性痰且痰量增加（C对）。咳嗽加重为慢性支气管炎急性加重的表现（A错），并不一定是伴发细菌感染。咳白色泡沫痰与黏液痰（B错）、肺底部有细湿啰音（E错）为慢性支气管炎时的临床表现与体征。肺部有哮鸣音（D错）为喘息性支气管炎和支气管哮喘的体征。